男性，58岁。有脑动脉硬化病史数年。急起不能讲话，四肢瘫痪，双侧面瘫，但神志清楚。有哪支脑动脉闭塞可能
A. 大脑后动脉
B. 小脑后小动脉
C. 基底动脉脑桥支
D. 大脑中动脉
E. 大脑前动脉

正确答案：C。基底动脉脑桥支